某女，22岁，身体偏寒，喜静，少动，其体质类型应辨为
A. 偏阳质
B. 气虚质
C. 偏阴质
D. 痰湿质
E. 瘀血质

正确答案：C。偏阴质

解析：本题考查的是体质的分类。某女，22岁，身体偏寒，喜静，少动，其体质类型应辨为偏阴质（C对）。人体正常体质大致可分为阴阳平和质、偏阳质、偏阴质三种类型。1.阴阳平和质：是指强健壮实、功能比较协调的体质类型。具有这种体质特征的人，不易感受外邪，平素患病较少，即使患病，易于治愈，康复亦快，有时可不药而愈，易获长寿。2.偏阳质（A错）：是指具有代谢相对亢奋、身体偏热、多动、易兴奋等特性的体质类型。具有这种体质特征的人，阳气偏亢，多动少静，对风、暑、热、燥等阳邪具有易感性，外感发病后多表现为热证、实证，易从阳化热伤阴。容易发生眩晕、头痛、心悸、失眠及出血等病症。在用药上宜凉润，忌用辛香燥热。3.偏阴质：是指具有代谢相对减退、身体偏寒、喜静少动等特征的体质类型。具有这种体质类型的人，对寒、湿等阴邪具有易感性，受邪发病后多表现为寒证、虚证；容易发生湿滞、水肿、痰饮、瘀血等病证。在用药上宜温，忌用苦寒。气虚质（B错）、痰湿质（D错）与瘀血质（E错），2022年考试指南未明确说明。